男，74岁，左腹股沟可复性包块10年，不能回纳8小时，以左腹股沟斜疝嵌顿急诊手术，术中见部分嵌顿小肠肠管色暗，无蠕动，行部分肠切除，此时不宜行疝修补术的理由是
A. 术前准备不充分
B. 术后易出现腹胀
C. 患者年龄大，伤口愈合能力低
D. 术后易继发手术野感染
E. 术后易发生上呼吸道感染

正确答案：D。术后易继发手术野感染

解析：老年男性患者，以左腹股沟斜疝行嵌顿急诊手术，术中见部分嵌顿小肠肠管色暗、无蠕动（说明嵌顿肠管已坏死，提示转变为绞窄性疝），此时宜采取单纯疝囊高位结扎术，不宜行疝修补术，否则术后易继发手术野感染（D对），使疝修补失败。腹壁的缺损应在以后另作择期手术予以加强。术前准备不充分（A错）时，不宜行疝修补术，但不是该患者不行疝修补术的理由。腹胀、上呼吸道感染为麻醉、术后的常见并发症；成年腹股沟疝病人都存在不同程度的腹股沟管前壁或后壁的薄弱或缺损，不论年龄大小均应行疝修补术，以加强或修补薄弱或缺损的腹壁，使病人得到彻底的治疗，因此，术后易出现腹胀（B错）、术后易发生上呼吸道感染（E错）和患者年龄大，伤口愈合能力低（C错）均不是该患者不宜行疝修补术的理由。